医学科学创新的前提和医学发展的动力是
A. 团结协作
B. 怀疑精神
C. 知识公开
D. 动机纯正
E. 公正无私

正确答案：B。怀疑精神

解析：怀疑精神是医学科学创新的前提，也是医学发展的动力。掌握“医学科研伦理的含义和要求”知识点。